前牙远中邻面洞累及切角的是G.V.Black分类中的几类洞
A. 第Ⅰ类洞
B. 第Ⅱ类洞
C. 第Ⅲ类洞
D. 第Ⅳ类洞
E. 第Ⅴ类洞

正确答案：D。第Ⅳ类洞

解析：G.V.Black分类：根据龋损所在牙面的部位，从治疗的观点出发，1908年Black把窝洞分为5类，目前仍作为充填治疗的基础分类，被广泛应用。Ⅰ类洞：为发生于所有牙齿的发育窝、沟内的龋损所制备的窝洞，称为Ⅰ类洞。包括磨牙（牙合）面窝沟洞，磨牙颊（舌）面的颊（舌）沟洞，前磨牙的（牙合）面窝沟洞，上前牙的腭面窝沟洞。以磨牙（牙合）面洞最具典型性。Ⅱ类洞：为发生于后牙邻面的龋损所制备的窝洞，称为Ⅱ类洞。包括磨牙和前磨牙的邻面洞、邻（牙合）面洞和邻颊（舌）面洞，以磨牙邻（牙合）面洞为典型代表。Ⅲ类洞：为发生于前牙邻面未损伤切角的龋损所制备的窝洞，称为Ⅲ类洞。包括切牙、尖牙的邻面洞、邻腭（舌）面洞、邻唇面洞。以切牙的邻腭面洞为典型代表。Ⅳ类洞：为发生于前牙邻面并损伤切角的龋损所制备的窝洞。包括切牙和尖牙的邻唇、邻腭（舌）面洞。目前，Ⅳ类洞含义已延伸，包括因牙外伤引起切角缺损的洞。Ⅴ类洞：为发生于所有牙齿的颊（唇）、舌（腭）面近龈1/3牙面的龋损所制备的窝洞。掌握“银汞充填窝洞的概念”知识点。